患者，男，28岁。素体阳气虚弱，今又感冒风寒，头痛身热恶寒，热轻寒重，无汗肢冷，倦怠嗜卧，面色苍白，语言低微，舌淡苔白，脉浮大无力。治疗应首选
A. 败毒散
B. 再造散
C. 小柴胡汤
D. 黄芪桂枝五物汤
E. 九味羌活汤

正确答案：B。再造散

解析：本题考查常见的病症的辩证、处方。题中患者素体阳气虚弱，今又感冒风寒，头痛身热恶寒，热轻寒重，无汗肢冷，倦怠嗜卧，面色苍白，语言低微，舌淡苔白，脉浮大无力，可辩证为阳气虚弱，外感风寒证。败毒散主治发汗解表，散风祛湿。用于伤寒温病，憎寒壮热，项强头痛，四肢酸痛，噤口痢疾，无汗鼻塞，咳嗽有痰（A错）。再造散为解表剂，具有助阳益气，散寒解表之功效。主治阳气虚弱，外感风寒。恶寒发热，热轻寒重，无汗肢冷，倦怠嗜卧，面色苍白，语言低微，舌淡苔白，脉沉无力，或浮大无力（B对）。小柴胡汤为和解剂，具有和解少阳之功效。主治伤寒少阳病证。邪在半表半里，症见往来寒热，胸胁苦满，默默不欲饮食，心烦喜呕，口苦，咽干，目眩，舌苔薄白，脉弦者；妇人伤寒，热入血室，经水适断，寒热发作有时；疟疾，黄疸等内伤杂病而见以上少阳病证者（C错）。黄芪桂枝五物汤为温里剂，具有益气温经，和血通痹之功效。主治血痹，肌肤麻木不仁，脉微涩而紧（D错）。九味羌活汤为解表剂，具有辛温解表，发汗祛湿，兼清里热之功效。主治外感风寒湿邪，内有蕴热证。恶寒发热，无汗，头痛项强，肢体酸楚疼痛，口苦微渴，舌苔白或微黄，脉浮（E错）。